抗前列腺增生药特拉唑嗪所致不良反应
A. 粒细胞计数减少
B. 体位性低血压
C. 性功能降低
D. 淋巴结肿大
E. 视物模糊

正确答案：B。体位性低血压

解析：本题考查药物不良反应。抗前列腺增生药物特拉唑嗪的主要不良反应是直立性低血压（即体位性低血压）（B对）、头晕、头痛、心悸、晕厥、逆向射精等。粒细胞减少（A错）、性功能低下（C错）、淋巴结肿大（D错）、视物模糊（E错）均不是特拉唑嗪的不良反应。